主要用于预防由蛛网膜下腔出血引起的脑血管痉挛及脑栓塞的是
A. 维拉帕米
B. 肾上腺素
C. 硝苯地平
D. 阿托品
E. 尼莫地平

正确答案：E。尼莫地平

解析：尼莫地平主要用于高血压和冠心病伴有脑血管病的患者，并可预防由蛛网膜下腔出血引起的脑血管痉挛及脑栓塞。掌握“钙通道阻滞药分类及代表药物”知识点。